影响噪声对机体作用的因素中最重要的是
A. 声压级大小
B. 频谱特征
C. 接触时间
D. 接触方式
E. 个体敏感性

正确答案：A。声压级大小